关于窝洞制备时隔湿的措施不当的有
A. 简易隔湿法
B. 吸唾器
C. 橡皮障隔湿
D. 排龈法
E. 冲水法

正确答案：E。冲水法

解析：术区隔离的措施包括：简易隔湿法、吸唾器、橡皮障隔湿、排龈法等。掌握“银汞充填术窝洞制备、干燥及充填”知识点。